药物流行病学是临床药学与流行病学两个学科相互渗透、延伸发展起来的新药研究领域，主要任务不包括
A. 新药临床试验前，药效学研究的设计
B. 药物上市前，临床试验的设计
C. 上市后药品有效性再评价
D. 上市后药品不良反应或非预期性作用的监测
E. 国家基本药物的遴选

正确答案：A。新药临床试验前，药效学研究的设计

解析：本题考查药物流行病学。新药临床试验前，药效学研究的设计（A错，为本题正确答案）属于药物的临床研究，不属于药物流行病学的主要任务。药物流行病学的主要任务有：1.药品上市前临床试验的设计（B对）和上市后药品有效性再评价（C对）；2.上市后药品的不良反应或非预期作用的监测（D对）；3.国家基本药物的遴选（E对）；4.药物利用情况的调查研究；5.药物经济学研究。